属于对因治疗的药物作用方式是
A. 胰岛素降低糖尿病患者的血糖
B. 阿司匹林治疗感冒引起的发热
C. 硝苯地平降低高血压患者的血压
D. 硝酸甘油缓解心绞痛的发作
E. 青霉素治疗脑膜炎奈瑟菌引起的流行性脑脊髓膜炎

正确答案：E。青霉素治疗脑膜炎奈瑟菌引起的流行性脑脊髓膜炎

解析：本题考查药物的治疗作用。对因治疗是指用药后能消除原发致病因子，治愈疾病的药物治疗。例如，使用抗生素杀灭病原微生物从而控制感染性疾病，如青霉素治疗脑膜炎奈瑟菌引起的流行性脑脊髓膜炎（E对）。胰岛素降低糖尿病患者的血糖（A错）为补充疗法。阿司匹林治疗感冒引起的发热（B错）、硝苯地平降低高血压患者的血压（C错）、硝酸甘油缓解心绞痛的发作（D错）为对症治疗。